由于V2受体缺陷引起的肾性尿崩症，其相关的水孔蛋白是
A. AQP-4
B. AQP-1
C. AQP-2
D. AQP-5
E. AQP-3

正确答案：C。AQP-2

解析：由于V2受体缺陷引起的肾性尿崩症是由于其相关的水孔蛋白AQP-2（C对）无法受到血管升压素的正常调节，导致水的通透性大增，从而导致产生的一种症状。